关于人体实验的第一个伦理学文献是
A. 《赫尔辛基宣言》
B. 《纽伦堡法典》
C. 《日内瓦宣言》
D. 《东京宣言》
E. 《夏威夷宣言》

正确答案：B。《纽伦堡法典》

解析：本题考查关于人体实验的第一个伦理学文献。关于人体实验的第一个伦理学文献是《纽伦堡法典》（B对）。1946年，在德国纽伦堡对纳粹医生进行审判的基础上，制订、发表了著名的《纽伦堡法典》，为医学人体实验制定了“一是必须有利于社会；二是应该符合伦理道德和法律”为主要内容的基本准则，作为世界医学界的行为规范，使医学真正为人类服务。《赫尔辛基宣言》（A错）是1964年在芬兰赫尔辛基召开的第18届世界医学大会上通过的，制定了关于指导人体实验研究的基本伦理准则，强调了人体实验必须经受试者知情同意，这一文献到2008年已修改到第六稿。《日内瓦宣言》（C错）是1948年，世界医学会以《希波克拉底誓言》为蓝本，颁布通过，作为全世界医务人员共同遵守的行为准则。《东京宣言》（D错）是1975年10月在东京召开的第29届世界医学大会上通过，规定了《关于对拘留犯和囚犯给予折磨、虐待、非人道的对待惩罚时医师的行为准则》。《夏威夷宣言》（E错）是1977年在夏威夷召开的第6届世界精神病学大会上通过，是关于精神病医生道德准则。